职业性肿瘤最好发的部位为
A. 肝脏和肺
B. 肺和脑
C. 肺和皮肤
D. 皮肤和骨骼
E. 卵巢和子宫

正确答案：C。肺和皮肤